下列关于己糖激酶叙述正确的是
A. 己糖激酶又称为葡萄糖激酶
B. 它催化的反应基本上是可逆的
C. 使葡萄糖活化以便参加反应
D. 催化反应生成6-磷酸果酸
E. 是酵解途径的唯一的关键酶

正确答案：C。使葡萄糖活化以便参加反应

解析：在己糖激酶催化下，葡萄糖活化成6-磷酸葡萄糖（D错）以便参加反应（C对），它催化的反应是不可逆的（B错），是糖酵解的第一个限速步骤。哺乳类动物体内已发现有4种己糖激酶同工酶（Ⅰ～Ⅳ型），只有肝细胞中存在的Ⅳ型才称为葡糖激酶，因此不能把己糖激酶称为葡萄糖激酶（A错）。糖酵解途径共有三个关键酶：己糖激酶、磷酸果糖激酶-1和丙酮酸激酶，己糖激酶并非是酵解途径的唯一的关键酶（E错）。